动眼神经
A. 上斜肌
B. 内直肌
C. 外直肌
D. 瞳孔开大肌
E. 眼轮匝肌

正确答案：B。内直肌

解析：内直肌（B对）由动眼神经控制；上斜肌（A错）由滑车神经控制；外直肌（C错）由展神经控制；瞳孔开大肌（D错）由颈上神经节控制；眼轮匝肌（E错）由面神经控制。